下列哪一项不是垂直型食物嵌塞的原因
A. （牙合）面的形态异常
B. 邻接关系异常
C. 对颌充填式牙尖
D. 牙齿松动
E. 牙龈乳头退缩

正确答案：E。牙龈乳头退缩

解析：本题考查垂直型食物嵌塞的原因。牙龈乳头退缩（E错，为本题的正确答案），使因外展隙增大，在进食时，唇颊和舌的运动可将食物压入牙间隙造成水平性食物嵌塞。垂直型食物嵌塞指食物从牙合面垂直方向嵌入牙间隙内，此种食物嵌塞嵌入较紧，不易剔除。（牙合）面被磨损（牙合）面的形态异常（A对）而使食物外溢道消失，致使食物被挤入牙间隙。邻面接触区由于磨损由点接触变为面接触，邻接关系异常（B对），食物溢出道消失，易发生垂直性食物嵌塞。对颌充填式牙尖（C对）能将食物挤入对颌牙的牙间隙引发垂直性嵌塞。牙齿松动（D对）接触不佳，易垂直性食物嵌塞。